为了防止手术创口的血液、分泌物进入呼吸道引起气道梗阻，通常采取
A. 气管切开
B. 实施机械呼吸
C. 人工呼吸
D. 药物维持
E. 以上都不对

正确答案：B。实施机械呼吸

解析：为了防止手术创口的血液、分泌物进入呼吸道，引起气道梗阻，口腔颌面部手术行全身麻醉时，一般都要求经鼻腔或口腔插入气管导管，再与麻醉装置连接，实施机械呼吸及吸入麻醉。掌握“全身麻醉”知识点。